氨苯蝶啶作用的特点是
A. 产生低氯碱血症
B. 具有抗醛固酮作用
C. 产生高血糖反应
D. 产生高血钾症
E. 产生低血钠症

正确答案：D。产生高血钾症